依照《麻醉药品、第一类精神药品购用印鉴卡管理规定》，《印鉴卡》有效期满需换领新卡的医疗机构，还应当提交原《印鉴卡》有效期间内麻醉药品、第一类精神药品的
A. 管理情况
B. 储存情况
C. 使用情况
D. 购入情况
E. 保管情况

正确答案：C。使用情况

解析：本题考查印鉴卡。依照《麻醉药品、第一类精神药品购用印鉴卡管理规定》，《印鉴卡》有效期满需换领新卡的医疗机构，还应当提交原《印鉴卡》有效期间内麻醉药品、第一类精神药品的使用情况（C对）。印鉴卡管理：根据《麻醉药品和精神药品管理条例》，为加强对医疗机构购用麻醉药品和第一类精神药品的管理，防止麻醉药品和第一类精神药品流入非法渠道，保证医疗需求，原卫生部制定了《〈麻醉药品、第一类精神药品购用印鉴卡〉管理规定》（卫医发〔2005〕421号）并于2005年11月2日发布。医疗机构应当凭《印鉴卡》向本省（区、市）行政区域内的定点批发企业购买麻醉药品和第一类精神药品。1.取得《印鉴卡》的必备条件：医疗机构向设区的市级卫生行政部门提出办理《印鉴卡》，应当具备下列条件。（1）有与使用麻醉药品和第一类精神药品相关的诊疗科目。（2）具有经过麻醉药品和第一类精神药品培训的、专职从事麻醉药品和第一类精神药品管理的药学专业技术人员。（3）有获得麻醉药品和第一类精神药品处方资格的执业医师。（4）有保证麻醉药品和第一类精神药品安全储存的设施和管理制度。2.《印鉴卡》有效期为3年。《印鉴卡》有效期满前3个月，医疗机构应当向市级卫生行政部门重新提出申请。《印鉴卡》有效期满需换领新卡的医疗机构，还应当提交原《印鉴卡》有效期期间内麻醉药品、第一类精神药品使用情况。3.当《印鉴卡》中医疗机构名称、地址、医疗机构法人代表（负责人）、医疗管理部门负责人、药学部门负责人、采购人员等项目发生变更时，医疗机构应当在变更发生之日起3日内到市级卫生健康主管部门办理变更手续。4.市级卫生行政部门自收到医疗机构变更申请之日起5日内完成《印鉴卡》变更手续，并将变更情况抄送所在地同级药品监督管理部门、公安机关，报省级卫生行政部门备案。